治疗大细胞贫血时可增加叶酸疗效的是
A. 维生素B₁₂
B. 叶酸
C. 维生素C
D. 铁剂
E. 维生素B₆

正确答案：C。维生素C

解析：本题考查大细胞贫血的治疗。治疗大细胞贫血时可增加叶酸疗效的是维生素C（C对ABDE错），维生素C可以促进铁元素的吸收，能将不易吸收的三价铁转化为二价铁，使肠胃更容易吸收，可以有效防止贫血的出现。。